极化液常用于心肌梗死并发的心律失常，其中胰岛素有何作用
A. 加速心肌葡萄糖的氧化以供能
B. 促进K⁺进入细胞内
C. 减少游离酮体，预防酮症酸中毒
D. 纠正低血钾
E. 促进心肌蛋白质合成

正确答案：B。促进K⁺进入细胞内

解析：本题考查胰岛素的药理作用。极化液常用于心肌梗死并发的心律失常，其中胰岛素作用是促进K⁺进入细胞内（B对）。极化液提供葡萄糖、胰岛素、氯化钾，可使细胞外K⁺进入心肌细胞内，改善缺血心肌代谢，促进葡萄糖进入心肌细胞内，同时还可以激活钠钾ATP酶，促使心肌细胞膜复极化，保护缺血损伤的心肌，其中胰岛素起到的是促进K⁺进入细胞内的作用。而非加速心肌葡萄糖的氧化以供能（A错）、减少游离酮体，预防酮症酸中毒（C错）、纠正低血钾（D错）、促进心肌蛋白质合成（E错）。